以上选项中，属于奇穴特性的是
A. 以痛为输
B. 是经验效穴
C. 主治病证较多
D. 归属于十四经脉
E. 是腧穴的主要组成部分

正确答案：B。是经验效穴

解析：经外奇穴是指既有一定的名称，又有明确的位置，但尚未归入或不便归入十四经脉系统的腧穴。这类腧穴的主治范围比较单纯，多数对某些病证有特殊疗效，故又称“奇穴”。奇穴一般都是在阿是穴的基础上发展而来的，其中部分穴位如膏肓俞、厥阴俞等后来还补充到十四经穴中，由此可推论奇穴本身又是经穴发展的来源，属于经验效穴（B对）。